头孢克洛生物半衰期约为1h，口服头孢克洛胶囊后，其在体内基本清除干净（99%）的时间约是
A. 7h
B. 2h
C. 3h
D. 14h
E. 28h

正确答案：A。7h

解析：本题考查静脉滴注半衰期个数与达坪浓度分数的关系。静脉滴注给药达到稳态血药浓度的百分数与半衰期之间的关系式为：n=-3.32lg（1-fss），fss为达坪分数，n表示静脉滴注给药达到坪浓度某一分数所需半衰期的个数。所以静脉滴注给药达到稳态血药浓度99%所需半衰期为6.64个，达到稳态血药浓度99%所需半衰期约为7个（A对）。